下列内分泌疾病属于功能亢进的是
A. 库欣综合征
B. 黏液性水肿
C. 尿崩症
D. 呆小症
E. 糖尿病

正确答案：A。库欣综合征

解析：库欣综合征为各种病因造成肾上腺分泌过多糖皮质激素（主要是皮质醇）（A对）所致病症的总称。黏液性水肿（B错）是甲状腺功能减退导致的。尿崩症（C错）是由于下丘脑-神经垂体病变引起抗利尿激素的缺乏导致的。呆小症（D错）是一种先天甲状腺发育不全或功能低下造成幼儿发育障碍的代谢性疾病。糖尿病（E错）是由于胰岛素分泌缺陷或其生物作用受损，或两者兼有引起的。